根据《医疗机构制剂配制监督管理办法（试行）》，应办理《医疗机构制剂许可证》许可事项变更的
A. 医疗机构名称变更
B. 法定代表人变更
C. 制剂室负责人变更
D. 注册地址变更
E. 医疗机构类别变更

正确答案：C。制剂室负责人变更

解析：本题考查的是《医疗机构制剂许可证》的变更。根据《医疗机构制剂配制监督管理办法（试行）》，应办理《医疗机构制剂许可证》许可事项变更的制剂室负责人变更（C对）。《医疗机构制剂许可证》变更分为许可事项变更和登记事项变更。许可事项变更是指制剂室负责人、配制地址、配制范围的变更；登记事项变更是指医疗机构名称（A错）、医疗机构类别（E错）、法定代表人（B错）、注册地址（D错）等事项的变更。